“阳胜则阴病”的含义是
A. 阴液不足，阳气相对亢盛
B. 阳热亢盛，阴液受损
C. 亡阴则阳无所依附而散越
D. 阳气不足，阴寒内盛
E. 阴邪为病，阳气受损

正确答案：B。阳热亢盛，阴液受损

解析：阳偏胜，即是阳盛，指机体在疾病过程中所出现的阳邪偏盛、功能亢奋、机体反应性增强而产生热象的病机变化。若阳盛伤及阴液，则兼有口渴、小便短少等表现，即所谓“阳盛则热”“阳盛则阴病”（B对）。阴偏衰的病机特点为阴液不足，阴不制阳，阳气相对偏盛（A错）。阴阳互根互用，亡阴则阳无所依附而散越（C错）。阳气不足，阴寒内盛是指机体阳气不足，阳不制阴，阴相对偏亢，导致“阳虚则阴盛”（D错）。阴偏盛的病机特点为阴盛而阳未虚，临床表现以实寒证为主，若阴盛伤及阳气，可兼有脘腹冷痛，溲清，便溏等表现，即所谓“阴盛则寒”“阴盛则阳病”（E错）。